顺序为阿片生物碱、半合成阿片镇痛药、人工合成镇痛药的是
A. 吗啡、可待因、芬太尼
B. 可待因、芬太尼、布托啡诺
C. 吗啡、氢吗啡酮、美沙酮
D. 双氢可待因、氢吗啡酮、右丙氧芬
E. 吗啡、芬太尼、喷他佐辛

正确答案：C。吗啡、氢吗啡酮、美沙酮

解析：本题考查麻醉性镇痛药。顺序为阿片生物碱、半合成阿片镇痛药、人工合成镇痛药的是吗啡、氢吗啡酮、美沙酮（C对）。麻醉性镇痛药依来源可分为三类。阿片生物碱：代表药吗啡、可待因。②半合成吗啡样镇痛药：如双氢可待因、氢吗啡酮。③合成阿片类镇痛药：依据化学结构不同可分为四类，a.苯哌啶类，如芬太尼；b.二苯甲烷类，如美沙酮；c.吗啡烷类，如左啡诺；d.苯并吗啡烷类，如喷他佐辛。